女婴，8个月。水样便3天，10余次/日，呕吐3～4次/日，尿量减少。查体：体重8Kg，眼窝凹陷，皮肤弹性差，四肢尚暖，血钠125mmol/L。该患儿最可能的诊断是
A. 轻度低渗性脱水
B. 重度低渗性脱水
C. 中度低渗性脱水
D. 中度等渗性脱水
E. 轻度等渗性脱水

正确答案：C。中度低渗性脱水

解析：患儿，已经腹泻、呕吐3天，并有尿量减少、眼窝凹陷、皮肤弹性差、四肢尚暖的临床症状，说明该患儿属于中度脱水。体检得血钠125mmol/L在低于130mmol/L的范围内，可诊断为低渗性脱水。综上所述该患儿为中度低渗性脱水（C对）。